以下哪项既属于第一级预防，也属于第三级预防
A. 控烟
B. 体力活动促进
C. 高血压管理
D. 环境有害因素的整治
E. 脑卒中病人的功能锻炼

正确答案：C。高血压管理

解析：①第一级预防：是针对病因所采取的预防措施。它既包括针对健康个体的措施也包括针对整个公众的社会措施。在第一级预防中，如果在疾病的因子还没有进入环境之前就采取预防性措施，则称为根本性预防。②第二级预防：在疾病的临床前期做好早期发现、早期诊断、早期治疗的“三早”预防工作，以控制疾病的发展和恶化。对于传染病，除了“三早”，尚需做到疫情早报告及患者早隔离，即“五早”。③第三级预防：对已患某些病者，采取及时的、有效的治疗和康复措施，使患者尽量恢复生活和劳动能力，能参加社会活动并延长寿命。如高血压的控制，就高血压本身来讲，是三级预防，但对脑卒中和冠心病来讲，是第一级预防。掌握“预防医学概论、健康及三级预防策略”知识点。